粉末在水、稀盐酸或稀氢氧化钠溶液中均不溶解的中药材是
A. 芒硝
B. 炉甘石
C. 滑石
D. 赭石
E. 石膏

正确答案：C。滑石

解析：本题考查的是滑石饮片的性状鉴别。粉末在水、稀盐酸或稀氢氧化钠溶液中均不溶解的中药材是滑石（C对）。滑石：【性状鉴别】饮片滑石粉为白色或类白色、微细、无砂性的粉末，手摸之有滑腻感。气微，味淡。在水、稀盐酸或稀氢氧化钠溶液中均不溶解。芒硝（A错）：【性状鉴别】饮片玄明粉为白色粉末。气微，味咸。有引湿性。炉甘石（B错）：【性状鉴别】饮片煅炉甘石呈白色、淡黄色或粉红色的粉末；体轻，质松软而细腻光滑。气微，味微涩。赭石（D错）：【性状鉴别】药材为鲕状、豆状、肾状集合体。多呈不规则的扁平块状。暗棕红色或灰黑色，条痕樱红色或红棕色，有的有金属光泽。一面多有圆形的突起，习称“钉头”；另一面与突起相对应处有同样大小的凹窝。体重，质硬，砸碎后断面显层叠状。气微，味淡。石膏（E错）：【性状鉴别】饮片煅石膏为白色粉末或酥松块状物。表面透出微红色的光泽，不透明。体较轻，质软，易碎，捏之成粉。气微，味淡。